刺激引起兴奋的基本条件是使跨膜电位达到
A. 峰电位
B. 阈电位
C. 负后电位
D. 局部电位
E. 正后电位

正确答案：B。阈电位